造成乳剂酸败的原因是
A. Zeta电位降低
B. 分散相与连续相存在密度差
C. 微生物及光、热、空气等的作用
D. 乳化剂失去乳化作用
E. 乳化剂类型改变

正确答案：C。微生物及光、热、空气等的作用

解析：本题考查乳剂。酸败（C对）是指乳剂受外界因素及微生物的影响，使其中的油、乳化剂等发生变质的现象。所以乳剂中通常需加入抗氧剂和防腐剂，防止氧化或酸败。ζ电位降低（A错）是乳剂发生絮凝的原因。分散相与连续相存在密度差（B错）是乳剂发生分层的原因。乳化剂失去乳化作用（D错）是乳剂发生破裂的原因。乳化剂类型改变（E错）是乳剂发生酸败的原因。